中年男子，猛抬重物后腰部剧烈痛并向右下肢放射，右足麻木，其诊断最大可能是
A. 腰椎骨折
B. 腰椎滑脱
C. 腰部肌筋膜炎
D. 腰椎间盘突出症
E. 腰扭伤

正确答案：D。腰椎间盘突出症

解析：患者为中年男子，猛抬重物后，腰部剧烈痛并向右下肢放射、右足麻木（腰椎间盘突出症典型表现），结合患者病史和临床表现，其诊断最大可能为腰椎间盘突出症（D对）。腰椎滑脱（P734）（B错）表现为下腰痛，一般无神经症状。腰椎骨折（P684）（A错）主要表现为局部疼痛，站立及翻身困难，无放射痛。腰部肌筋膜炎（C错）指肌肉和筋膜的无菌性炎症反应，是一种慢性劳损性疾病，主要表现为腰部疼痛，压痛较明显。腰扭伤（E错）后立即出现腰部疼痛，呈持续性剧痛，一般无放射痛和麻木感。